女，75岁。胸痛5小时。心电图示V₁-V₅导联ST段抬高0.5mV。对改善预后最有效的措施是
A. 卧床休息
B. 静脉注射瑞替普酶(rt-PA）
C. 静脉滴注硝酸甘油
D. 静脉滴注丹红注射液
E. 静脉滴注极化液

正确答案：B。静脉注射瑞替普酶(rt-PA）

解析：患者老年女性，胸痛5小时（心肌缺血、心肌梗死典型症状），心电图示V₁-V₅导联ST段抬高0.5mV（心梗典型心电图）。根据患者症状及心电图，考虑可能是急性心肌梗死。静脉注射瑞替普酶（B对）激活血栓中纤溶酶原，使其转变为纤溶酶而溶解冠状动脉内的血栓可以帮助改善预后。卧床休息（A错）可以防止不良刺激，解除患者焦虑。静脉滴注硝酸甘油（C错）为减轻心绞痛的治疗。静脉滴注丹红注射液（D错）具有活血化瘀，通脉舒络的功能，用于瘀血闭阻所致的胸痹及中风。静脉滴注极化液（E错）能使病态的心肌细胞恢复细胞膜的极化状态，对保护缺血损伤的心肌、改善窦房和房室传导，防止心律失常均有一定作用。